硫脲类抗甲状腺药可引起的严重不良反应是
A. 粘液性水肿
B. 心动过缓
C. 粒细胞缺乏症
D. 低蛋白血症
E. 再生障碍性贫血

正确答案：C。粒细胞缺乏症

解析：硫脲类药物是最常用的抗甲状腺药物，可发生胃肠道反应、过敏反应、粒细胞缺乏症和甲状腺肿及甲状腺功能减退等不良反应，其中最严重的是粒细胞缺乏症（C对），一般发生在治疗后的2～3个月内，老年人较易发生，应定期检查血象，同时应注意与甲亢引起的白细胞减少相区别。粘液性水肿（A错）、心动过缓（B错）为甲状腺功能低下的表现，硫脲类抗甲状腺药可引起甲状腺功能低下，但这不是最严重的不良反应。低蛋白血症（D错）为肾病综合征的诊断标准之一。再生障碍性贫血（E错）多由氯霉素类抗生素、磺胺类药物及抗肿瘤化疗药物等引起。